患者胁肋胀痛，常因情志变动而痛有增减，胸闷不舒，嗳气吞酸，饮食减少，舌红苔薄黄，脉弦数。治疗应选用
A. 川楝子
B. 橘皮
C. 木香
D. 佛手
E. 枳实

正确答案：A。川楝子

解析：患者胁肋胀痛，常因情志变动而痛有增减，胸闷不舒，嗳气吞酸，饮食减少，舌红苔薄黄，脉弦数为肝郁化火证，治以清肝火、泄郁热、行气止痛。川楝子苦寒降泄，入肝经，能清肝火、泄郁热，具有行气止痛，杀虫的功效（A对）。橘皮（陈皮）入脾、肺经，能行脾肺之气而止痛，具有理气健脾，燥湿化痰的功效，没有清肝火、泄郁热的功效（B错）。木香善通行脾胃之气滞，为行气止痛之要药，又为健脾消食之佳品，走三焦和胆经，既能行气健脾又能疏肝利胆，没有清肝火的功效（C错）。佛手具有疏肝解郁，理气和中，燥湿化痰的功效，可治疗肝郁气滞及肝胃不和之胸胁胀痛，脘腹痞满等，没有清肝火的功效（D错）。枳实具有破气消积，化痰除痞的功效，治疗气血阻滞之胸胁疼痛，没有清肝火的功效（E错）。